丁香的主治病证是
A. 虚寒呃逆
B. 阳虚外感
C. 寒郁肝脉
D. 气血亏虚
E. 寒饮咳喘

正确答案：A。虚寒呃逆

解析：本题考查丁香的主治病证。丁香的主治病证是虚寒呃逆（A对）。丁香【主治病证】（1）中寒呃逆、呕吐、泄泻，脘腹冷痛。（2）肾阳虚之阳痿、宫冷。细辛【主治病证】（1）风寒表证（尤宜鼻塞、头痛、肢体疼痛较甚者），阳虚外感（B错）。（2）鼻渊头痛。（3）头风头痛，牙痛，风寒湿痹痛。（4）寒饮咳喘（E错）。荔枝核【性能特点】本品微苦泄散，甘温能通，入肝、胃经。能行气、散结、祛寒而止痛，善治寒滞肝脉（C错）及肝胃不和所致诸痛。紫河车【主治病证】（1）肾虚精亏之不孕、阳痿、遗精、腰酸。（2）气血两亏之面色萎黄、消瘦乏力、产后少乳。（3）肺肾两虚之气喘咳嗽。（4）癫痫久发，气血亏虚（D错）。